不属于计算机检索药物信息的方法是
A. 截词检索法
B. 加权检索法
C. 组配检索法
D. 扩检或缩检法
E. 抽检法

正确答案：E。抽检法

解析：本题考查抽检法的分类。抽检法（E错，为本题正确答案）是指从一批产品中随机抽取少量产品进行检验，以判断该批产品是否合格的统计方法和理论，不属于计算机检索方法。